脊髓骶段第2--4节支配哪个器官
A. 空肠
B. 升结肠
C. 盲肠
D. 横结肠
E. 膀胱

正确答案：E。膀胱

解析：由脊髓骶部第2-4节段的骶副交感核发出的节前纤维随骶神经出骶前孔，而后从骶神经分出组成盆内脏神经加入盆丛，随盆丛分支分布到盆腔脏器，在脏器附近或脏器壁内的副交感神经节交换神经元，节后纤维支配结肠左曲以下的消化管和盆腔脏器（E对）。